某心理治疗师婉拒了一位正在接受其治疗的患者请其吃饭的邀请。该心理治疗师的这一行为所遵循的心理治疗原则是
A. 保密原则
B. 关系限定原则
C. 真诚原则
D. 客观中立原则
E. 回避原则

正确答案：B。关系限定原则

解析：关系限定原则（B对）即在心理咨询的场面设定时，原则上禁止与来访者除咨询室之外的任何接触和交往，也不能将自己的情绪带进咨询过程，不对来访者在感情上产生爱憎和依恋，更不能在咨询过程中寻求在爱憎、欲求等方面的满足和实现。虽咨访关系的确立和咨询工作的顺利进展的关键，是咨询者和来访者心理的沟通和接近。但这也是有限度的，来自来访者的劝诱和要求，即便是好意的在终止咨询之前也是应该予以拒绝的。例如，“老师，我们一起吃饭好吗？”“到我这里来玩吧？”“我们去一个清静的地方谈好吗？”等来自来访者的要求是不应答应下来的。个人间接触过密的话，不仅容易使来访者过于了解咨询者内心世界和私生活，阻碍来访者的自我表现，也容易使咨询者该说的不能说，从而失去客观公正地判断事物的能力。保密原则（A错）可以理解为心理咨询最重要的原则，它既是咨访双方确立相互信任的咨询关系的前提，也是咨询活动顺利开展的基础。这一原则要求在没有得到对方同意的时候，不得将在咨询场合下对方的言行随意泄露给任何人或机关。真诚原则（C错）是指治疗者应当以真诚的态度，认真地了解病人的症状、发病机制、诊断及治疗过程中的反应，并在慎重地确定治疗方案之后，还要根据具体情况不断地进行修正和完善。客观中立原则（D错）是指治疗者对治疗中涉及的各类事件均应保持客观、中立的立场，不把个人的观点强加于患者。回避原则（E错）是指心理咨询及治疗中涉及到患者个人隐私问题，熟人及家属应回避。